用于治疗肺结核
A. 异烟肼
B. 利福平
C. 两者均有
D. 两者均无

正确答案：C。两者均有